男，53岁。右季肋部胀痛1月余。查体：无黄疸，肝肋缘下3cm，质硬，无腹水征。B超示肝右叶低回声病灶，约11cm×10cm，肝左叶见多个小低回声区。AFP＞1000μg/L。最佳的治疗措施是
A. 放射治疗
B. 抗感染治疗
C. 肝动脉插管栓塞化疗
D. 剖腹探查
E. 中草药治疗

正确答案：C。肝动脉插管栓塞化疗

解析：中老年患者肝大，质硬。B超示肝右叶肿块，AFP＞1000μg/L（AFP＞400μg/L考虑肝癌），考虑原发性巨块型肝癌。患者左叶见多个小低回声区，有肝内转移，不适用手术治疗，肝动脉插管栓塞化疗（C对）是最佳的治疗方式。放射治疗（A错）适用于病灶局限、肝功能较好的早期患者。患者无明显感染指征，不需进行抗感染治疗（B错）。剖腹探查（D错）属于检查手段，不属于治疗措施。中草药治疗（E错）对肝癌效果尚待验证。